几乎仅发生在腮腺的肿瘤的是
A. 沃辛瘤
B. 多形性腺瘤
C. 腺样囊性癌
D. 腺泡细胞癌
E. 黏液表皮样癌

正确答案：A。沃辛瘤

解析：沃辛瘤的组织发生与淋巴结有关。在胚胎发育时期，腮腺和腮腺内的淋巴组织同时发育，此时淋巴组织只是聚集成团的淋巴细胞，尚未形成淋巴结的包膜，因此，腺体组织可以迷走到淋巴组织中。形成淋巴结包膜以后，腺体组织包裹在淋巴结中。组织学观察，在腮腺淋巴结中常可见到腺体组织。这种迷走的腺体组织发生肿瘤变，即为沃辛瘤。掌握“腺样囊性癌”知识点。